实邪结聚，阻滞经络，气血不能外达所形成的病证是
A. 实证
B. 虚证
C. 虚实夹杂证
D. 真虚假实证
E. 真实假虚证

正确答案：E。真实假虚证

解析：实邪结聚，阻滞经络，本质为邪实，气血不能外达，表现为虚，表面假象为虚（E对）。实证指邪气盛，是以邪气亢盛为矛盾主要方面的病机变化，无气血不能外达之象（A错）。虚证指正气不足，是以正气虚损为矛盾主要方面的病机变化，无实邪结聚（B错）。虚实夹杂证指在疾病过程中，邪盛和正虚同时存在的病机变化（C错）。因体质虚弱，脏腑精气功能减退而出现闭塞症状的真虚假实证（D错）。